有助于确定新生儿缺氧缺血性脑病损害严重程度和判断预后的检查首选
A. 脑氢质子磁共振波谱
B. 头颅CT
C. 头颅MRI
D. 脑电图
E. 颅脑超声检查

正确答案：D。脑电图

解析：有助于确定新生儿缺氧缺血性脑病损害严重程度和判断预后的检查首选脑电图（D对），新生儿缺氧缺血性脑病时脑电图的可表现为脑电活动延迟（落后于实际胎龄）、异常放电，背景活动异常等。头颅CT（B错）、头颅MRI（C错）、颅脑超声检查（E错）都对新生儿缺氧缺血性脑病有辅助检查的价值，可以诊断损害和出血的部位等，但并不是新生儿缺氧缺血性脑病损害严重程度和判断预后的首选检查。新生儿缺氧缺血性脑病很少用到脑氢质子磁共振波谱进行检查（A错）。